某男，20岁。素体较弱，近1月来时发肢麻，甚则抽搐。曾在某医院就诊治疗无效。刻诊肢麻依旧，纳食及二便正常。舌淡红，苔薄腻，脉弦。证属血虚经脉失养兼有风湿。治以养血舒筋、祛风除湿。药用当归12g炒、白芍15g、酒木瓜10g、鸡血藤15g、炙甘草6g、秦艽10g防风、防己各10g、桑枝30g、生牡蛎30g打碎先煎。6剂每日1剂水煎服。宜避风寒忌食生冷、着凉水。以此方加减治疗半年身体复常。方中木瓜善益筋血、平肝舒筋，关于其性能特点的说法错误的是
A. 酸温祛邪扶正两相兼
B. 专入肝经
C. 舒筋祛湿生津而不燥不敛
D. 酸生津而不敛湿邪
E. 温化湿而不燥烈伤阴

正确答案：B。专入肝经

解析：本题考查的是木瓜的性能特点。木瓜入肝、脾经（B错，为本题正确答案）。木瓜：【性味归经】酸，温。归肝、脾经。【性能特点】本品酸温，祛邪扶正两相兼（A对），舒筋祛湿生津而不燥不敛（C对），酸生津而不敛湿邪（D对），温化湿而不燥烈伤阴（E对）。入肝经，益筋血而平肝舒筋；入脾经，生津开胃、祛湿和中。治湿痹与脚气浮肿最宜，治吐泻转筋、血痹肢麻与津亏食少可投。